下列各项，最易发生代谢性碱中毒的是
A. 慢性肾功能不全
B. 休克
C. 肠痿
D. 幽门梗阻
E. 急性肾功能不全

正确答案：D。幽门梗阻

解析：代谢性碱中毒是指原发的血浆碳酸氢根升高而引起的一系列病理生理过程，常见病因包括幽门梗阻（D对）等。慢性肾功能不全（A错）、急性肾功能不全（E错）可导致机体排酸障碍，从而引起代谢性酸中毒；休克（B错）可导致机体产酸过多，从而引起代谢性酸中毒；肠痿（C错）可导致机体碱性物质丢失过多，从而引起代谢性酸中毒。